治疗铜绿假单胞菌感染首选的药物
A. 磺胺嘧啶
B. 四环素
C. 异烟肼
D. 甲氧苄啶
E. 环丙沙星

正确答案：E。环丙沙星

解析：环丙沙星（E对）是合成第三代喹诺酮类抗菌药物，具广谱抗菌活性，杀菌效果好，对肠杆菌、绿脓杆菌等具有抗菌作用，可作为治疗铜绿假单胞菌感染首选的药物。异烟肼（C错）可用于治疗结核病选用的药物。磺胺嘧啶（A错）磺胺类药属广谱抗菌药，但由于目前许多临床常见病原菌对该类药物耐药，故仅用于敏感细菌及其他敏感病原微生物所致的感染。四环素（B错）为广谱抑菌剂，高浓度时具杀菌作用，对革兰氏阳性菌、阴性菌、立克次体、滤过性病毒、螺旋体属乃至原虫类都有很好的抑制作用。甲氧苄啶（D错）对多种革兰氏阳性和阴性细菌有效，但由于细菌对本品将易产生耐药性，故不宜单独作为抗菌药使用。